乳磨牙脱落后，下颌第一恒磨牙向近中移动距离较上颌第一恒磨牙移动得多的是
A. 上唇系带位置过低
B. 中切牙间间隙
C. 暂时性远中（牙合）
D. 暂时性前牙拥挤
E. 暂时性深覆（牙合）

正确答案：C。暂时性远中（牙合）

解析：暂时性远中（牙合）：在建（牙合）初期，上下颌第一恒磨牙的关系为远中（牙合）。乳磨牙脱落后，下颌第一恒磨牙向近中移动距离较上颌第一恒磨牙移动得多，成为中性（牙合）关系。掌握“（牙合）的生长发育”知识点。